善温脾开胃摄唾的药是
A. 砂仁
B. 益智仁
C. 肉豆蔻
D. 沙苑子
E. 菟丝子

正确答案：B。益智仁

解析：本题考查的是益智仁的功效。善温脾开胃摄唾的药是益智仁（B对）。益智仁：【功效】暖肾固精缩尿，温脾止泻摄唾。砂仁（A错）：【功效】化湿行气，温中止泻，安胎。肉豆蔻（C错）：【功效】涩肠止泻，温中行气。沙苑子（D错）：【功效】补肾固精，养肝明目。菟丝子（E错）：【功效】补阳益阴，固精缩尿，明目止泻，安胎，生津。